肝癌的组织学类型，最多见的是
A. 肝细胞型
B. 胆管细胞型
C. 结节型
D. 弥漫型
E. 混合型

正确答案：A。肝细胞型

解析：根据组织学类型可将肝癌分为肝细胞肝癌、胆管细胞癌和混合型肝癌。肝细胞型（A对）最为多见，约占原发性肝癌的90%，胆管细胞型（B错）肝癌癌较少见，混合型（E错）肝癌最少见。结节型（C错）和弥漫型（D错）属于肝癌的大体病理形态分型。